对G⁺菌有较强抗菌作用的是
A. 红霉素
B. 诺氟沙星
C. 盐酸金刚乙烷
D. 庆大霉素
E. 甲硝唑

正确答案：A。红霉素

解析：红霉素（A对）属于大环内酯类抗生素，对G⁺菌有较强的抗菌作用，临床常用于治疗耐青霉素的金黄色葡萄球菌、表皮葡萄球菌等感染。诺氟沙星（B错）（P398）主要对G⁻菌如大肠杆菌、志贺菌、沙门菌等极为有效。盐酸金刚乙胺（C错）（P411）是抗病毒药，对细菌无作用。庆大霉素（D错）（P388）对治疗各种G⁻杆菌有较强的抗菌作用。甲硝唑（E错）（P403）主要对厌氧菌作用较强。